IMP转变成GMP的过程中经历了
A. 氧化反应
B. 还原反应
C. 脱水反应
D. 硫化反应
E. 生物转化

正确答案：A。氧化反应

解析：IMP由天冬氨酸提供氨基，合成嘌呤核苷酸，或氧化成黄嘌呤核苷酸，再有谷氨酰胺提供氨基，合成鸟嘌呤核苷酸。掌握“核苷酸代谢及调节”知识点。